下颌左右5678缺失患者。如果剩余牙槽嵴低平或呈刃状，黏膜薄弱。左右下4固位体宜采用
A. 三臂卡环
B. 隙卡
C. RPI卡环
D. 延伸卡环
E. 圈形卡环

正确答案：A。三臂卡环

解析：本题考查卡环的种类及适应证。可摘局部义齿有三种支持方式，包括牙支持式、黏膜支持式和混合支持式。当患者牙槽嵴低平、黏膜薄弱时，应尽量采用牙支持式或混合支持式，以减轻牙槽骨和黏膜所受（牙合）力。三臂卡环（A对）由颊、舌两臂及支托组成，支托可将义齿所承受的咀嚼压力传递到基牙上，减轻黏膜及牙槽嵴负荷。隙卡（B错）作为一种间接固位体，可防止义齿旋转，但没有将（牙合）力分担到基牙上的作用。RPI卡环（C错）通过其近中（牙合）支托、远中邻面板的作用，使基牙受力减少，基托下黏膜和牙槽骨受力增加，会使患者黏膜压痛、加速牙槽骨的吸收，不适用于该患者。延伸卡环（D错）对松动基牙有固定夹板作用，但不能有效的分担（牙合）力至基牙上。圈形卡环（E错）多用于最后孤立磨牙的远中，起固位和稳定作用，但没有分担（牙合）力的作用。